患者女，17岁，因失恋割腕自杀未遂。检查发现：拇指对掌功能障碍和手的桡侧半感觉障碍，示、中指远节感觉消失，初步判断应为
A. 腓总神经损伤
B. 桡神经损伤
C. 正中神经损伤
D. 尺神经
E. 颅神经损伤

正确答案：C。正中神经损伤

解析：拇指对掌功能障碍和手的桡侧半感觉障碍，示、中指远节感觉消失，神经损伤为正中神经损伤（C对）。腓总神经损伤（A错）以小腿前外侧伸肌群麻痹，轻微的肌无力甚至完全缺失运动功能为临床表现。桡神经损伤（B错）一般有垂腕表现。尺神经损伤（D错）一般有爪形手表现。